药学职业道德规范要求，药学工作人员在直接面对患者时，应当遵守的内容包括
A. 济世为怀，清廉正派
B. 仁爱救人，文明服务
C. 科学严谨，理明术精
D. 相互监督，文明促销
E. 谦让谨慎，独立创新

正确答案：A、B、C。济世为怀，清廉正派；仁爱救人，文明服务；科学严谨，理明术精

解析：本题考查药学职业道德规范。药学工作人员在直接面对患者时，应当遵守的道德规范内容：济世为怀，清廉正派（A对）、仁爱救人，文明服务（B对）、科学严谨，理明术精（C对）。